组成视交叉中央部的神经纤维是
A. 右眼鼻侧半视网膜与右眼颞侧半视网膜发出的纤维
B. 左眼颞侧半视网膜与右眼鼻侧半视网膜发出的纤维
C. 右眼颞侧半视网膜与左眼鼻侧半视网膜发出的纤维
D. 左右眼颞侧半视网膜发出的纤维
E. 左右眼鼻侧半视网膜发出的纤维

正确答案：E。左右眼鼻侧半视网膜发出的纤维

解析：组成视交叉中央部的神经纤维是左右眼鼻侧半视网膜发出的纤维（E对）。